下列各组药中，属配伍禁忌的是
A. 巴豆与牵牛
B. 丁香与三棱
C. 牙硝与郁金
D. 官桂与五灵脂
E. 人参与石脂

正确答案：A。巴豆与牵牛

解析：本题考查中药配伍禁忌，属记忆内容。根据十九畏歌诀硫黄原是火中精，朴硝一见便相争。水银莫与砒霜见，狼毒最怕密陀僧。巴豆性烈最为上，偏与牵牛不顺情。丁香莫与郁金见，牙硝难合京三棱。川乌草乌不顺犀，人参最怕五灵脂。官桂善能调冷气，若逢石脂便相欺，大凡修和看顺逆，炮爁炙煿莫相依。可以得出巴豆畏牵牛（A对）。丁香畏郁金（B错）。牙硝畏三棱（C错）。官桂畏赤石脂（D错）。人参与石脂（E错）。